有关烤瓷合金说法错误的是
A. 不易形成表面氧化膜
B. 铸造金属烤瓷修复体的金属基底的合金
C. 良好的生物相容性
D. 耐腐蚀
E. 高强度

正确答案：A。不易形成表面氧化膜

解析：所谓烤瓷合金就是用于铸造金属烤瓷修复体的金属基底的合金。对烤瓷合金的要求除了良好的生物相容性，高强度，耐腐蚀外，还必须能够形成表面氧化膜，与陶瓷材料之间形成化学结合；与陶瓷材料的热膨胀系数相匹配，烤瓷合金的热膨胀系数应略高于陶瓷：熔点显著高于陶瓷：具有良好的高温强度，即抵抗高温（烤瓷烧结温度）变形能力。掌握“修复材料、金瓷结合及树脂粘结机制”知识点。